急性胰腺炎最常见的临床表现是
A. 腹泻
B. 呕吐
C. 停止排气排便
D. 黄疸
E. 上腹部疼痛

正确答案：E。上腹部疼痛

解析：腹泻（A错）、呕吐（B错）是多数胃肠道疾病常见的症状之一，但不是急性胰腺炎的最常见体征，无特异性。停止排气排便是肠梗阻患者常见的临床表现（C错）。黄疸可见于溶血性疾病、肝脏及胆道性疾病（D错）。上腹部疼痛是急性胰腺炎常见的主要症状，常发生于饱餐和饮酒后突然发作，多位于左上腹，并伴左肩及左腰背部放射痛（E对）。